患儿，10岁。患急性肾小球肾炎，症见眼睑先肿，继而四肢，皮肤光亮，指压不显，小便短黄，镜下血尿，体温38℃，间有咳嗽，苔薄白，脉浮数。其证型是
A. 水气上凌心肺
B. 气虚邪恋
C. 湿热内侵
D. 邪陷厥阴
E. 风水相搏

正确答案：E。风水相搏

解析：急性肾小球肾炎风水相搏证起病急，水肿自眼睑开始迅速波及全身，以头面部肿势为著，皮色发亮，按之凹陷随手而起，尿少色赤，恶风寒或发热汗出，咽红咽痛，骨节酸痛，鼻塞流涕，咳嗽，舌质淡，苔薄白或薄黄，脉浮。肾阳不足，气化失司故见见眼睑先肿，继而四肢，皮肤光亮，指压不显；水气上逆射肺故见咳嗽（E对）。水气上凌心肺见全身明显水肿，频咳气急，胸闷心悸，烦躁不宁，不能平卧，面色苍白，甚则唇甲青紫，舌质暗红、舌苔白腻，脉沉细无力（A错）。气虚邪恋证候：身倦乏力，面色萎黄，纳少便溏，自汗，易于感冒，或见血尿持续不消，舌淡红、苔白，脉缓弱（B错）。湿热内侵证候：浮肿或轻或重，尿少色赤，皮肤生疮或咽喉肿痛，头身困重，脘闷纳呆，口渴口苦，心烦，大便秘结或溏而不爽，或伴发热，舌红，苔黄腻，脉滑数（C错）。邪陷厥阴证候：头痛眩晕，视物模糊，烦躁不安，口苦，恶心呕吐，甚至惊厥，抽搐，昏迷，肢体面部水肿，尿短赤，舌质红，苔黄糙，脉弦数（D错）。